阿昔洛韦抗病毒能力正确顺序是
A. HSV-2，HSV-1，水痘-带状疱疹病毒，EB病毒
B. HSV-1，HSV-2，水痘-带状疱疹病毒，EB病毒
C. HSV-1，HSV-2，EB病毒，水痘-带状疱疹病毒
D. HSV-2，HSV-1，EB病毒，水痘-带状疱疹病毒
E. HSV-1，EB病毒，HSV-2，水痘-带状疱疹病毒

正确答案：B。HSV-1，HSV-2，水痘-带状疱疹病毒，EB病毒

解析：本题考查阿昔洛韦抗病毒的能力。阿昔洛韦属于核苷类抗病毒药，被认为是抗单纯疱疹病毒最有效的药物。阿昔洛韦可在病毒感染的细胞内利用病毒胸腺嘧啶核苷激酶的催化生成单磷酸盐，进一步转化为三磷酸阿昔洛韦，对病毒DNA多聚酶具有强大的抑制作用。阿昔洛韦对不同病毒有不同的抗病毒能力，其抗病毒能力正确顺序是HSV-1，HSV-2，水痘-带状疱疹病毒，EB病毒（B对ACDE错）。